女，45岁。四肢无力，站立不稳，进行性加重半年，无外伤史。查体：双下肢肌张力高、腱反射亢进。Hoffmann征（+），Babinski征（+）。其诊断为
A. 脊髓型颈椎病
B. 神经根型颈椎病
C. 椎动脉型颈椎病
D. 交感神经型颈椎病
E. 混合型颈椎病

正确答案：A。脊髓型颈椎病

解析：女，45岁。四肢无力，站立不稳（提示颈椎节段以上平面脊椎可能存在损伤），进行性加重半年，无外伤史（排出由急性外伤所引起的脊髓损伤）。查体：双下肢肌张力高、腱反射亢进。Hoffmann征（+），Babinski征（+）（提示高位脊髓损伤）。其诊断为脊髓型颈椎病（A对）。脊髓型颈椎病由于颈椎退变结构压迫脊髓，主要表现为四肢无力、走路踩棉花感，触觉障碍，双手精细动作笨拙，查体可出现感觉障碍平面，肌力减退，肌张力增高，四肢腱反射活跃或亢进，病理征反射阳性。神经根型颈椎病（B错）由于颈椎间盘侧后方突出、钩椎关节或关节突关节增生、肥大，刺激或压迫神经根所致。临床上开始多为颈肩痛，并向上肢放射。同时可出现上肢无力、手指动作不灵活等。椎动脉型颈椎病（C错）由于椎动脉受压迫或刺激，出现椎-基底动脉供血不全。临床上表现为偏头痛、耳鸣、听力减退或耳聋、视力障碍、发音不清、突发晕眩而猝倒。交感神经型颈椎病（D错）发病机制尚不清楚。临床上表现为交感神经兴奋症状如头痛或偏头痛，有时伴恶心、呕吐；视物模糊，视力下降，瞳孔扩大或缩小，心跳加速，心率不齐，血压升高等。混合型颈椎病（E错）是指同时发生上述颈椎病中的两种或两种以上的类型，但题干只出现了脊髓型颈椎病的症状，故不考虑该分型。